可用于治疗甲癣、足癣、体癣和股癣等浅表性真菌感染的药物是
A. 氟胞嘧啶
B. 伏立康唑
C. 两性霉素B
D. 特比萘芬
E. 卡泊芬净

正确答案：D。特比萘芬

解析：本题考查特比萘芬。特比萘芬（D对）临床适用于：（1）毛癣菌（红色毛癣菌、须癣毛癣菌、断发癣菌、紫色毛癣菌和疣状毛癣菌等）、犬小孢子菌和絮状表皮癣菌等引起的皮肤、头发和甲的感染。（2）各种癣病（体癣、股癣、手足癣和头癣等）以及念珠菌（白色念珠菌等）引起的皮肤酵母菌感染。（3）皮霉菌引起的甲癣（甲真菌感染）。氟胞嘧啶（A错）是抗真菌药，对念珠菌、隐球菌、地丝菌有良好的抑制作用，对部分曲菌，以及引起皮肤真菌病的分支孢子菌、瓶真菌等也有作用。对其它真菌和细菌都无作用。伏立康唑（B错）是一种广谱的三唑类抗真菌药，其适应证如下：治疗侵袭性曲霉病。治疗对氟康唑耐药的念珠菌引起的严重侵袭性感染（包括克柔念珠菌）。治疗由足放线病菌属和镰刀菌属引起的严重感染。两性霉素B（C错）临床上用于治疗严重的深部真菌引起的内脏或全身感染。卡泊芬净（E错）适用于成人患者和儿童患者(三个月及三个月以上）：经验性治疗中性粒细胞减少、伴发热病人的可疑真菌感染治疗对其它治疗无效或不能耐受的侵袭性曲霉菌病。